下列哪项是外科感染应用抗生素的原则
A. 选择广谱抗生素
B. 选择抗革兰氏阴性菌的抗生素
C. 选择抗革兰氏阳性菌的抗生素
D. 根据病灶细菌培养和药物敏感试验选用抗生素
E. 以上均非

正确答案：D。根据病灶细菌培养和药物敏感试验选用抗生素

解析：抗生素使用要点：①合理用药：一般较轻的局限性感染可不用抗生素；能用单一抗生素控制感染的就不联合使用抗生素；能用窄谱抗生素的不用广谱抗生素（A错）。只有严重感染或病原菌不明，对所用抗生素产生耐药性者，才考虑使用广谱抗生素及联合用药。联合用药时不宜选择抑菌剂和杀菌剂同用。②选药原则：应根据细菌培养与药敏试验选用有效药物（D对），在细菌培养与药敏试验尚无明确结果时，一般以临床表现、脓液性状、感染部位初步判断致病菌种，选用适当抗菌药物（BC错）。若应用2～3天无明显效果，则应调整更换。③给药途径：一般感染可口服或肌注，严重感染或全身性感染必须静脉给药。以静脉分次注射效果最好，可迅速提高单位时间血药浓度。